检查发现牙石，探诊可发现牙石，但探针黑色部分全部露在龈袋外，CPI记分为
A. 2
B. 3
C. 4
D. 9
E. X

正确答案：A。2

解析：本题考查社区牙周指数（CPI）。探诊可发现牙石，但探针黑色部分全部露在龈袋外，CPI记分为2（A对）。CPI检查即在指数牙上检查牙龈出血，牙周袋深度，牙结石三项内容。社区牙周指数（CPI）记分标准：0＝牙龈健康；1＝龈炎，探诊后出血；2＝牙石，探诊可发现牙石，但探针黑色部分全部露在龈袋外；3＝早期牙周病，龈缘覆盖部分探针黑色部分，龈袋深度在4～5mm；4＝晚期牙周病，探针黑色部分被龈缘完全覆盖，牙周袋深度在6mm或以上；X＝除外区段（少于两颗功能牙存在）；9＝无法检查（不记录）。